血管神经性水肿又称
A. 接触性口炎
B. 固定性药疹
C. 巨型荨麻疹
D. 过敏性口炎
E. 药物性口炎

正确答案：C。巨型荨麻疹

解析：血管神经性水肿是一种发生于皮下疏松组织或黏膜的局限性水肿，为一种暂时性、局限性、无痛性皮下黏膜下水肿，好发于上唇，又称为巨型荨麻疹，亦称奎英克水肿。掌握“血管神经性水肿”知识点。